治疗小儿泄泻脾肾阳虚证，应首选
A. 健脾益气，参苓白术散
B. 补脾温肾，附子理中汤
C. 温阳救逆，参附龙牡汤
D. 温肾健脾，真武汤
E. 温阳扶正，参附汤

正确答案：B。补脾温肾，附子理中汤

解析：小儿泄泻脾肾阳虚证，虚则补之，当补脾温肾，病位在中下焦，故当用附子理中汤合四神丸加减。选项中无四神丸，当附子温补肾阳之功已俱，附子理中汤当为最佳选择（B对）。健脾益气之法用于脾虚泻，方用参苓白术散（A错）。温阳救逆之法用于阳脱证，方用参附龙牡汤（C错）。温肾健脾之法适用于脾肾阳虚证，但真武汤温中之力较弱，也不能固涩止泻（D错）。温阳扶正适用于阳虚证，但参附汤较之附子理中汤温阳之力较弱（E错）。